根据Kennedy分类法，872|1278缺失属于
A. 第一类第二亚类
B. 第二类第一亚类
C. 第二类第二亚类
D. 第三类第二亚类
E. 第四类第二亚类

正确答案：A。第一类第二亚类

解析：本题考查Kennedy牙列缺损分类。872|1278缺失是双侧后牙78缺失，远中无天然牙存在，属于第一类；前牙部分缺失2|12，是非连续缺失，两个缺隙，属于第二亚类（A对）。第二类第一亚类（B错）指牙弓一侧后部牙缺失，远中无天然牙存在且还存在一个缺牙间隙。第二类第二亚类（C错）指牙弓一侧后部牙缺失，远中无天然牙存在且还存在两个缺牙间隙。 第三类第二亚类（D错）指牙弓的一侧牙缺失，缺隙两端均有天然牙存在且还存在两个缺牙间隙。 第四类指牙弓前部牙连续缺失并跨过中线，天然牙在缺隙远中，为单缺隙，无亚类，因为要以最后的缺牙间隙决定分类，如果第四类还存在别的缺牙间隙，则就不属于第四类了,所以没有第四类第二亚类（E错）这种说法。